基托与黏膜两者间可形成功能性负压腔，使义齿获得固位的
A. 摩擦力
B. 吸附力
C. 表面张力
D. 大气压力
E. 重力

正确答案：D。大气压力

解析：大气压力：当基托与黏膜紧密贴合、边缘封闭时，在大气压力作用下，两者间可形成功能性负压腔，使义齿获得固位。掌握“局部义齿人工牙及基托”知识点。